慢性心衰时，机体最有效的代偿方式是：
A. 心率加快
B. 心肌肥大
C. 心脏紧张源性扩张
D. 血容量增加
E. 血流重新分布

正确答案：B。心肌肥大

解析：慢性心衰时，机体可通过心脏本身和心外机制代偿。心脏本身的代偿包括心率增快、心脏紧张源性扩张、心肌收缩性增强、心室重塑。心外代偿包括血容量增加、血液重新分布。心肌肥大（B对）是对室壁张力增加产生的适应性变化，其可降低心室壁张力、增加心脏总收缩力，是慢性心衰最有效的代偿方式。但心肌肥大的代偿作用也是有一定限度的，过度肥大的心肌反而会加重心脏负担，使心功能由代偿转为失代偿。